检测IgE含量常用的简单方法是
A. 凝集反应
B. 单向琼脂扩散
C. ELISA
D. 免疫电泳
E. 免疫荧光法

正确答案：C。ELISA